发生肺血栓栓塞时，应首先考虑溶栓的情况是
A. 合并深静脉血栓形成
B. 剧烈胸痛
C. 严重低氧血症
D. 持续低血压
E. 明显咯血

正确答案：D。持续低血压

解析：肺血栓栓塞症临床分三型，高危、中危、低危，其中高危临床上以休克和低血压为主要表现，即体循环动脉收缩压＜90mmHg，或较基础值下降幅度≥40mmHg，持续15分钟以上，此型病情变化快，预后差，需积极予以溶栓治疗，可见持续低血压（D对）是判断是否需要溶栓治疗的重要指标。肺血栓栓塞症的患者，只要血压和右心室运动功能均正常，就不需要溶栓治疗。因此合并深静脉血栓形成（A错）、剧烈胸痛（B错）、严重低氧血症（C错）、明显咯血（E错）均不能作为是否溶栓的指标。